男，6岁。身高80cm，智能落后，仅能数1～20个数。体检：皮肤粗糙，毛发枯干，表情呆板，腹隆，四肢短小，骨龄摄片仅有4枚骨化核。患儿确诊后治疗应选用
A. 低苯丙氨酸饮食
B. 低铜饮食
C. 生长激素
D. 甲状腺素
E. 脑活素脑复康

正确答案：D。甲状腺素

解析：由于患儿自身甲状腺素合成不足，应尽早行替代治疗，终生服用甲状腺制剂，不能中断（D对）。低苯丙氨酸饮食（A错）可缓解苯丙酮尿症；生长激素（C错）用于治疗侏儒症；脑活素脑复康（E错）用于神经衰弱，脑动脉硬化引起的体倦头晕、中风、半身不遂、高血压性脑出血后的脑血肿、脑血栓；低铜饮食（B错）可缓解肝豆状核变性。